患者女，25岁产后乳少，乳房胀满疼痛，胸胁胀闷，舌红，苔薄黄，脉弦除乳根膻中少泽外，应加取
A. 中脘、天枢、期门
B. 足三里、脾俞、胃俞
C. 太冲、内关、期门
D. 太冲、外关、肝俞
E. 肝俞、膈俞、期门

正确答案：C。太冲、内关、期门

解析：乳少的肝气郁结证配太冲、内关、期门。太冲平肝息风，清热利湿，通络止痛；内关宽胸解郁，行气止痛；期门为肝经募穴，健脾疏肝，理气活血（C对）。中脘为胃之募穴、腑之会穴，可和胃理肠；天枢为大肠募穴，理气止痛，活血散瘀，清利湿热 ；期门为肝经募穴，健脾疏肝，理气活血（A错）。足三里为足阳明合穴、胃之下合穴，可扶土而补中气；脾俞补脾益气；胃俞清胃泻火（B错）。外关为足少阳经与阳维脉的交会穴，治疗胁肋痛；肝俞乃肝之背俞穴，有疏肝理气之作用（D错）。肝俞乃肝之背俞穴，有疏肝理气之作用；膈俞理气宽胸，活血通脉（E错）。